在致畸试验中，提示啮齿类动物“受孕”（交配）的证据是
A. 雌雄动物同笼的时间
B. 雌性动物的活动
C. 有阴栓发现
D. 雌雄动物数目的比例
E. 雌性动物的体重增加

正确答案：C。有阴栓发现